男，60岁，一年来右侧上后牙痛，痛多在傍晚发生，并涉及右眶下部和颞部。患者数年前曾有头痛及流涕史。查：右上5远中（牙合）面和右上6（牙合）面深龋，叩痛（+），扪痛（+），右上7和右上4牙冠完整，叩痛（-），右上8残根。为明确诊断必须做的检查是牙髓温度测试，该患者主诉疾病最可能是慢性牙髓炎，治疗设计中最重要的是
A. 垫底充填
B. 根管治疗
C. 盖髓治疗
D. 拔除残根
E. 耳鼻喉科就诊

正确答案：B。根管治疗

解析：本题考查慢性牙髓炎的治疗。慢性牙髓炎需要进行根管治疗（B对），彻底清除根管内的感染物质，严密充填根管，这在牙髓炎治疗中至关重要。垫底充填（A错）用于中龋和深龋的治疗，该患者已出现慢性牙髓炎，需要进行根管治疗。盖髓治疗（C错）适用于深龋未穿髓或穿髓孔小于0.5mm的情况，不可用于有慢性牙髓炎的患牙。拔除残根（D错）适用于右上8，此次就诊的主诉牙牙冠尚存，牙根条件较好，尚有保留价值，可以根管治疗之后根据具体情况决定是否需要冠修复，不能拔除。该患者可能有慢性鼻窦炎，可以去耳鼻喉科就诊（E错），但是这并不是此次治疗的最重要的内容。